牙髓塑化治疗的适应证中，以下哪项是错误的
A. 成人后牙不可复性牙髓炎
B. 成人后牙牙髓坏死
C. 成人后牙慢性根尖周炎
D. 器械折断于根尖1/3处，未出根尖孔
E. 根尖孔已破坏的根尖周炎

正确答案：E。根尖孔已破坏的根尖周炎

解析：本题考查牙髓塑化治疗的适应证。不适用于根尖孔已破坏的根尖周炎（E错，为本题的正确答案），因为塑化液会超出根尖孔，刺激根尖周组织，不利于病变愈合。牙髓塑化治疗是指将根管内部分牙髓抽出，不必进行扩大根管等复杂的操作步骤，而将配制好的塑化液注入根管内，与牙髓组织聚合一体，达到消除病源刺激物的作用。塑化治疗操作简便，疗效好，适应于成人后牙不可复性牙髓炎（A对）、成人后牙牙髓坏死（B对）、成人后牙慢性根尖周炎（C对），不可用于根尖孔未封闭的年轻恒牙，因为会影响其牙根的继续发育。当根管弯曲细小，或器械折断于根尖1/3处，未出根尖孔（D对），未能取出时，选择塑化治疗是最佳方案。